女，35岁，支气管哮喘重度发作2天，使用氨茶碱，沙丁胺醇，大剂量激素治疗无效。体检：呼吸浅快，口唇发绀，神志不清，双肺哮鸣音较弱，血气分析：PaO₂50mmHg，PaCO₂70mmHg进一步救治措施应为
A. 静脉推注地塞米松
B. 给予高浓度吸氧
C. 静脉滴注5%碳酸氢钠
D. 联合应用抗生素静脉滴注
E. 气管插管，正压机械通气

正确答案：E。气管插管，正压机械通气

解析：患者为支气管哮喘重度发作，氨茶碱，沙丁胺醇，大剂量激素治疗无效且PaCO₂ 70mmHg（正常值为35～45mmHg），首要处理是改善患者通气功能，增加氧供，应及时给予机械通气治疗（E对），其指征主要包括呼吸肌疲劳、PaCO₂≥45mmHg、意识改变（需进行有创通气治疗）。该患者已使用大剂量激素治疗无效，故静脉推注地塞米松（A错）无效，且大剂量应用激素副反应严重。支气管哮喘的患者因气道痉挛，给予高浓度吸氧（B错）不能有效缓解机体缺氧的状态。静脉滴注5%碳酸氢钠（C错）仅可以纠正患者的酸中毒状态，但不能缓解患者的缺氧状态。联合应用抗生素静脉滴注（D错）用于伴发多重细菌感染的患者，该患者是由于支气管哮喘重度发作，导致的缺氧状态，故应用抗生素滴注不能改善缺氧。